关于精囊的叙述，错误的是
A. 为一囊状腺体
B. 表面凹凸不平
C. 由迂曲的管道构成
D. 位于输精管壶腹的下内侧
E. 无

正确答案：D。位于输精管壶腹的下内侧

解析：精囊为一囊状腺体（A对）。表面凹凸不平（B对）。由迂曲的管道构成（C对）。位于膀胱底的后方，输精管壶腹的下外侧（D错，为本题正确答案）。